甲肝传染性最强的时期
A. 潜伏期末到前驱期
B. 潜伏期末到痊愈
C. 仅在潜伏期末
D. 出现症状后
E. 恢复期

正确答案：A。潜伏期末到前驱期

解析：本题考查甲肝传染性最强的时期。甲肝主要经粪-口途径传播，从潜伏期末到前驱期（A对BCDE错）的这段时间里，病人粪便中的病毒数量最多，此时甲肝的传染性最强。